以下哪项不是艾滋病的传播方式
A. 输血传播
B. 性接触传播
C. 口腔飞沫传播
D. 母婴垂直传播
E. 静脉吸毒传播

正确答案：C。口腔飞沫传播

解析：本题考查艾滋病的传播方式。HIV病毒对外界抵抗力低，一般不会通过口腔飞沫传播（C错，为本题的正确答案）。艾滋病的传播方式包括：1.性接触传播（B对）；2.血液接触传播：共用针具静脉吸毒（E对），输入被HIV污染的血液或血制品（A对）以及介入性医疗操作等均可受感染；3.母婴垂直传播（D对）。